有关乳酸循环的描述，错误的是
A. 可防止乳酸在体内堆积
B. 最终从尿中排出乳酸
C. 使肌肉中的乳酸进入肝脏异生成葡萄糖
D. 可防止酸中毒
E. 使能源物质避免损失

正确答案：B。最终从尿中排出乳酸

解析：乳酸循环是指肌收缩（尤其是氧供应不足时）通过糖无氧氧化生成乳酸，乳酸透过细胞膜弥散进入血液后，再入肝异生为葡萄糖（C对），葡萄糖释入血液后又可被肌摄取，由此构成的一个循环。乳酸属于能源物质，可通过乳酸循环被回收利用，因此不会从尿中排出（B错，为本题正确答案）。乳酸循环具有重要的生理意义，既能使能源物质避免损失（E对），又可避免因乳酸堆积而引起酸中毒（AD对）。